BTT
A. 紫外检测器
B. 荧光检测器
C. 火焰离子化检测器
D. 旋光计
E. 红外分光光度计

正确答案：A、B。紫外检测器；荧光检测器

解析：本题考查高效液相色谱法。高效液相色谱法的检查器：（1）选择性检测器：紫外检测器（A对）；光电二极管阵列检测器；荧光检测器（B对）；电化学检测器；质谱检测器。（2）通用型检测器：蒸发光散射检测器；示差折光检测器。